患者，男，47岁，2型糖尿病史，饮食不规律，近期因口服降糖药疗效不佳，欲改为三餐前即刻使用胰岛素或胰岛素类似物控制血糖，应选
A. 门冬胰岛素
B. 精蛋白锌胰岛素
C. 低精蛋白锌胰岛素
D. 普通胰岛素
E. 地特胰岛素

正确答案：A。门冬胰岛素

解析：本题考查胰岛素。三餐前即刻使用胰岛素或胰岛素类似物控制血糖，应选门冬胰岛素（A对）。门冬胰岛素为速效胰岛素，在餐前5～10min或餐后立即给药。精蛋白锌胰岛素（B错）为长效胰岛素，在早餐前30～60min服用。低精蛋白锌胰岛素（C错）为中效胰岛素，在早餐前30～60min服用。普通胰岛素（D错）为短效胰岛素，在餐前15～30min服用。地特胰岛素（E错）为长效胰岛素，在睡前服用。